在检查天疱疮时，用手指侧向推压外表正常的皮肤或黏膜，即可迅速形成水疱；推赶水疱能使其在皮肤上移动，这些现象称为
A. 克氏征阳性
B. 尼氏征阳性
C. 揭皮试验阳性
D. 边缘扩展阳性
E. 免疫荧光法阳性

正确答案：B。尼氏征阳性

解析：用手指侧向推压外表正常的皮肤或黏膜，即可迅速形成水疱；推赶水疱能使其在皮肤上移动；在口腔内，用舌舔及黏膜，可使外观正常的黏膜表层脱落或撕去，这些现象称尼氏征。比较有诊断价值的检查方法。掌握“天疱疮”知识点。